急性放射病严重程度可从哪一期判断
A. 初期
B. 极度期
C. 假愈期
D. 恢复期
E. 以上都不对

正确答案：C。假愈期